长期采用全胃肠外营养，理想静脉为
A. 颈内或锁骨下静脉
B. 颈外静脉
C. 头静脉
D. 大隐静脉
E. 上肢静脉

正确答案：A。颈内或锁骨下静脉

解析：肠外营养的输注途径主要有中心静脉和周围静脉途径。中心静脉途径适用于需要长期肠外营养，需要高渗透压营养液的病人。临床上常用的中心静脉途径有：颈内静脉途径、锁骨下静脉途径（A对）、经头静脉或贵要静脉插入中心静脉导管途径（不如前两个常用）。周围静脉途径适用于只需短期肠外营养支持的病人，通常采用浅表静脉。